男，36岁。因体表烧伤入院，估计深Ⅱ度面积为15%，Ⅲ度面积为25%。在烧伤创面处理过程中，患者突发寒战、高热不退，伴谵妄，尿少，白细胞计数升高。应考虑的主要并发症是
A. 补液不足
B. 药物超敏反应
C. 输血反应
D. 脓毒症
E. 毒血症

正确答案：D。脓毒症